城乡规划是
A. 是一定时期内城市和村镇建设、发展和管理的依据
B. 是城乡规划包括城市规划和村镇规划
C. 是城市或村镇在一定时期内的发展计划
D. 是城市各项建设的综合部署和具体安排
E. 以上都是

正确答案：E。以上都是

解析：本题考查城乡规划。城乡规划是指为了实现一定时期内城市、村庄和集镇的经济和社会发展目标，确定城市、村庄和集镇的性质、规模和发展方向，合理利用城乡土地，协调城乡空间布局和各项建设的综合部署和具体安排（E对ABCD错）。